患者，男，50岁，慢性咳嗽咳痰6年，肺功能测定为阻塞性通气功能障碍，下列哪项是错误的
A. 肺活量减低
B. 残气容积占肺总量的百分比降低
C. 第一秒用力呼气量减低
D. 残气量增加
E. 最大呼气中期流速减低

正确答案：B。残气容积占肺总量的百分比降低

解析：慢性支气管炎早期主要累及管径小于2mm的小气道，表现为不同程度的上皮细胞变性，坏死、增生，鳞状上皮化生，杯状细胞增生，黏膜及黏膜下层炎症细胞浸润，管壁黏膜水肿，分泌物增多，管壁有不同程度的炎性改变。肺功能表现为残气容积占肺总量的百分比增高（B对），肺活量减低（A错），第一秒用力呼气量减低（C错），残气量增加最大（D错），呼气中期流速减低（E错）。